患者身灼肢温，汗出如油，味咸而黏，脉细数疾，其临床意义是
A. 湿热郁蒸
B. 暑伤津气
C. 亡阳
D. 亡阴
E. 阴阳俱伤

正确答案：D。亡阴

解析：由于阴液亏虚欲绝，阴竭阳浮，迫津外泄，故见身灼肢温，汗出如油；脉细数疾，为阴伤重症之候；故辨为亡阴证（D对）。湿热郁蒸表现为蒸蒸汗出，汗液易使衣服黄染，面赤烘热，烦躁，口苦，小便色黄，舌苔薄黄，脉弦数（A错）。暑伤津气表现为发热恶热，心烦汗出，口渴喜饮，气短神疲，肢体困倦，小便短黄，舌红，苔白或黄，脉虚数（B错）。亡阳证表现为冷汗淋漓，汗液稀淡，面色苍白，手足厥冷，肌肤不温，神情淡漠，呼吸气弱，舌质淡润，脉微欲绝等（C错）。阴阳俱伤表现为少气无力，消瘦面黄，声喑音哑，潮热盗汗，骨蒸痨热，泄溏便急，痰白沫状或血痰，心悸气短，寡言少语，纳呆，自汗，滑精，闭经，苔黄燥，脉微细或虚大无力（E错）。